不属于生物地球化学性疾病的
A. 慢性镉中毒
B. 碘缺乏
C. 地方性氟中毒
D. 黑脚病
E. 克汀病

正确答案：A。慢性镉中毒

解析：生物地球化学性疾病是由于地壳表层化学元素分布不均引起土壤或水中某些元素过高或过低，进而引起某些特异性疾病。它包括碘缺乏（B对）、地方性氟中毒（C对）、黑脚病（地方性砷中毒）（D对）和克汀病（E对）。不包括慢性镉中毒（A错，为本题正确答案）。